粪隐血阳性可见于
A. 胃溃疡
B. 膀胱炎
C. 结肠癌
D. 胰腺炎
E. 急性白血病

正确答案：A、C、E。胃溃疡；结肠癌；急性白血病

解析：本题考查的粪隐血的临床意义。粪隐血阳性可见于胃溃疡（A对）、结肠癌（C对）于急性白血病（E对）。粪隐血：消化道少量出血时，红细胞被消化而分解，肉眼及显微镜下均不能出现，故称为“隐血”（OB），必须用化学方式检测，称为隐血试验（OBT）。对于老年人粪隐血试验有助于早期发现消化道恶性肿瘤。临床意义：1.消化道溃疡：胃、十二指肠溃疡者的隐血阳性率可达40%～70%，可呈间歇性阳性。2.消化道肿瘤：胃癌、结肠癌者的隐血阳性率可达87%～95%，并呈持续性阳性。3.其他疾病：见于肠结核、克罗恩病、溃疡性结肠炎；全身性疾病如紫癜、急性白血病、伤寒、回归热、钩虫病等。膀胱炎（B错）可见尿蛋白阳性、尿中白细胞（LEU）增多。胰腺炎（D错）可见淀粉酶与血清天门冬氨酸氨基转移酶升高。